升结肠癌的主要表现是
A. 便秘
B. 肠梗阻
C. 便血
D. 贫血
E. 腹泻

正确答案：D。贫血

解析：升结肠癌即右半结肠癌，一般右半结肠肠腔大，隆起型病变多见，瘤体向内增大时表面可产生溃疡，易出血坏死，表现为慢性失血等症状，病人出现贫血（D对）。降结肠为左半结肠癌，浸润型多见，癌肿沿肠壁各层弥漫浸润，使局部肠壁增厚、肠腔狭窄，但表面常无明显溃疡，出血坏死少见。因此，其主要引起肠梗阻（B错）、排便习惯如：便秘（A错）、腹泻（E错）与粪便性状改变如便血（C错）、便中带脓液或黏液等症状。